仅在局部增殖，不引起病毒血症的是
A. 麻疹病毒
B. 乙型脑炎病毒
C. 脊髓灰质炎病毒
D. 风疹病毒
E. 流行性感冒病毒

正确答案：E。流行性感冒病毒

解析：本题考查可引起病毒血症的疾病。流行性感冒病毒（E错，为本题的正确答案）一般不引起病毒血症。病毒可入血引起病毒血症的是麻疹病毒（A对）；乙型脑炎病毒（B对）；脊髓灰质炎病毒（C对）；风疹病毒（D对）。